肺痈患者，壮热面赤，咳嗽气急，咯痰腥臭，痰色黄绿，口渴。其治法是
A. 清肺化痰活血
B. 排脓解毒
C. 养阴清肺解毒
D. 清肺化瘀消痈
E. 清热解毒化痰

正确答案：D。清肺化瘀消痈

解析：邪热从表入里，热毒内盛，正邪交争，故壮热面赤；热毒壅肺，肺气上逆，则咳嗽气急；痰浊瘀热郁蒸成痈，则咯痰腥臭，痰色黄绿；热入血分，耗津伤液，则口渴。故辩证为肺痈成痈期，治宜清肺化瘀消痈（D对）。清肺化痰活血为痰热雍肺兼有血瘀的治法（A错）。排脓解毒为治疗肺痈溃脓期的治法（B错）。养阴清肺解毒为癌病肺癌阴虚毒热证的治法（C错）。清热解毒化痰为热毒痰瘀的治法（E错）。